办理校验应当交验《医疗机构执业许可证》，并提交
A. 《执业医师申请书》
B. 试用证明
C. 《医疗机构执业许可证》副本
D. 自治区卫生行政部门规定执业医师法材料
E. 直辖市卫生行政部门规定执业医师法材料

正确答案：C。《医疗机构执业许可证》副本

解析：医疗机构应当于校验期满前3个月向登记机关申请办理校验手续。办理校验应当交验《医疗机构执业许可证》，并提交下列文件：①《医疗机构校验申请书》；②《医疗机构执业许可证》副本；③省、自治区、直辖市卫生行政部门规定提交的其他材料。掌握“医疗机构登记和校验及法律责任”知识点。